保护生态环境的道德规范不包括
A. 热爱大自然，与自然为友
B. 优化生产方式，防止环境
C. 对保护有关生态环境的各种设施人人有责
D. 发展科学技术，合理利用自然资源，节约资源消费，生活方式实现生态化
E. 爱惜动植物，保护生态平衡

正确答案：C。对保护有关生态环境的各种设施人人有责